治疗肝昏迷的抗震颤麻痹药是
A. 左旋多巴
B. 苯海索
C. 溴隐亭
D. 金刚烷胺
E. 司来吉兰

正确答案：A。左旋多巴

解析：左旋多巴（A对）是体内合成多巴胺的前体物质，进入脑组织的左旋多巴，经脑内AADC脱羧转化为DA，补充纹状体DA不足，产生抗帕金森病作用，同时左旋多巴还可用于急性肝功能衰竭所致的肝昏迷，正常情况下，机体蛋白质的代谢产物苯乙胺和酪胺在肝脏被氧化解毒，肝昏迷时，苯乙胺和酪胺氧化解毒功能减弱，血中浓度升高，并大量进入脑内，经β-羟化酶形成“伪递质”苯乙醇胺和羟苯乙醇胺，其取代了正常递质NA，使神经功能紊乱，左旋多巴在脑内转化为DA，DA可进一步转化为NA，与伪递质相竞争，纠正神经功能的紊乱，使患者由昏迷转为苏醒，但这一作用不能改善患者肝功能，仅作为辅助治疗。苯海索（B错）为中枢胆碱受体阻断药，对帕金森引起的震颤效果较好，早期轻症患者疗效好，副作用较少。溴隐亭（C错）为非选择性的中枢多巴胺受体激动剂，大剂量可激动黑质-纹状体通路D₂受体，产生抗帕金森作用。金刚烷胺（D错）抗帕金森病作用机制涉及多个环节，包括促进黑质-纹状体多巴胺能神经末梢释放DA，疗效不及左旋多巴。司来吉兰（E错）为中枢神经系统MAO-B抑制药，能迅速通过血脑屏障，不可逆性抑制MAO-B，使纹状体DA浓度增加，作用时间延长，用于早期PD。